引起胰岛素抵抗性的诱因，哪项错误
A. 严重创伤
B. 酮症酸中毒
C. 并发感染
D. 手术
E. 暴饮暴食

正确答案：E。暴饮暴食